患者18岁，因牙齿不美观前来就诊，查右上中切牙较左上中切牙形态较大，X线片显示一个“小牙”被包在了中央，故诊断为
A. 融合牙
B. 双生牙
C. 牙内陷
D. 额外牙
E. 畸形中央尖

正确答案：C。牙内陷

解析：本题考查牙内陷的临床表现。患者，18岁，因牙齿不美观前来就诊，查右上中切牙较左上中切牙形态较大（部位在中切牙），X线片显示一个“小牙”被包在了中央（牙中牙），故诊断为牙内陷（C对）。牙中牙是牙内陷最严重的一种，常见于上颌侧切牙，也可见于上颌中切牙和尖牙。牙呈圆锥状，且较其固有形态稍大，X线片示其深入凹陷部好似包含在牙中的一个小牙，其实陷入部分的中央不是牙髓，而是含有残余成釉器的空腔。融合牙（A错）X线表现为牙根、牙冠完全融合；双生牙（B错）X线表现为牙冠的完全或不完全分开，有一个共同牙根和根管；额外牙（D错）X线表现为最多见于上颌两中切牙之间，圆锥形，根短小；畸形中央尖（E错）X线表现为刚萌出的牙咬合面中央窝处可见圆锥形突起的小牙尖。均不符合上述临床表现，且畸形中央尖多见于下颌第二前磨牙。